如果进行病例对照研究，能够不受预后因素干扰的病例应是
A. 典型病例
B. 新发病例
C. 老病例
D. 重病例

正确答案：B。新发病例

解析：本题考查新发病例的优点。在病例对照研究中，首选的病例类型是新发病例（B对ACD错），其优点在于：新发病例包括不同病情和预后的病人，代表性好，另外，病人确诊不久即被调查，对有关暴露的回忆信息较为准确可靠，不受各种预后因素的影响，且病历资料容易获得。